下列关于一般细菌的煮沸法灭菌要求正确的是
A. 80℃，30分钟
B. 87℃，15～20分钟
C. 90℃，30分钟
D. 100℃，15～20分钟
E. 100℃，60分钟

正确答案：D。100℃，15～20分钟